患者，男，15岁。阴囊内肿块，每日起床或站立后肿块缓慢增大，平卧位缩小。透光试验阳性。最可能的诊断为
A. 交通性鞘膜积液
B. 睾丸鞘膜积液
C. 隐睾
D. 精索鞘膜积液
E. 急性肠梗阻

正确答案：A。交通性鞘膜积液

解析：青少年男性患者，阴囊内肿块，每日起床或站立后肿块缓慢增大，平卧位缩小，透光试验阳性（交通性鞘膜积液的典型表现），最可能的诊断为交通性鞘膜积液（A对）。交通性鞘膜积液的患者由于鞘状突完全未闭合，鞘膜囊的积液可经一小管与腹腔相通，所以会出现立位时阴囊肿大，卧位时积液流人腹腔，鞘膜囊缩小或消失的临床表现。睾丸鞘膜积液（B错）患者的鞘状突闭合正常，积液不与腹腔相通；精索鞘膜积液（D错）患者的鞘状突的两端闭合，积液与腹腔、睾丸鞘膜囊都不相通，因此，上述两种疾病立位时肿块不增大，平卧位时肿块不缩小。隐睾症（C错）多见于小儿，表现为阴囊空虚，触诊时不能触及睾丸。急性肠梗阻（E错）主要表现为呕吐、腹痛、腹胀和停止排便排气，肿块位于腹部，透光试验阴性。